能满足某一特定人群中50%个体的营养需要系指
A. 估计平均需求量
B. 推荐摄入量
C. 适宜摄入量
D. 可耐受最高摄入量
E. 生理需要量

正确答案：A。估计平均需求量